肿势高突，根盘收束，常见于正盛邪实之疮疡的是
A. 热肿
B. 风肿
C. 虚肿
D. 实肿
E. 血肿

正确答案：D。实肿

解析：肿势高突，根盘收束，常见于正盛邪实之疮疡的是实肿（D对）。热肿：肿而色红，皮薄光泽，焮热疼痛，肿势急剧。常见于阳证疮疡，如疖疗初期、丹毒等（A错）。风肿：发病急骤，漫肿宣浮，或游走不定，不红微热，或轻微疼痛。常见于痄腮、大头瘟等（B错）。虚肿：肿势平坦，根盘散漫，常见于正虚不能托毒之疮疡（C错）。瘀血肿：肿而胀急，病程较快，色初暗褐，后转青紫，逐渐变黄至消退。也有血肿染毒、化脓而肿。常见于皮下血肿等（E错）。